某女，25岁，素体强壮。六月份突患上呼吸道感染，症见高热、烦躁。医师诊断为外感热病，热毒壅盛证。宜选用的中成药是
A. 芩连片
B. 黛蛤散
C. 清胃黄连丸
D. 新雪颗粒
E. 一清颗粒

正确答案：D。新雪颗粒

解析：本题考查的是新雪颗粒的主治。突患上呼吸道感染，症见高热、烦躁。医师诊断为外感热病，热毒壅盛证。宜选用的中成药是新雪颗粒（D对）。新雪颗粒：【主治】外感热病，热毒壅盛证，症见高热、烦躁；扁桃体炎、上呼吸道感染、气管炎、感冒见上述证候者。芩连片（A错）：【主治】脏腑蕴热，头痛目赤，口鼻生疮，热痢腹痛，湿热带下，疮疖肿痛。黛蛤散（B错）：【主治】肝火犯肺所致的头晕耳鸣、咳嗽吐衄、痰多黄稠、咽膈不利、口渴心烦。清胃黄连丸（C错）：【主治】肺胃火盛所致的口舌生疮，齿龈、咽喉肿痛。一清颗粒（E错）：【主治】火毒血热所致的身热烦躁、目赤口疮、咽喉及牙龈肿痛、大便秘结、吐血、咯血、衄血、痔血；咽炎、扁桃体炎、牙龈炎见上述证候者。